细菌DNA直接进入受体菌，称为
A. 转化
B. 转导
C. 溶原性转换
D. 接合
E. 原生质体融合

正确答案：A。转化